提呈可溶性Ag最有效的APC是
A. Mφ
B. 朗格汉斯细胞
C. DC
D. 并指状细胞
E. B细胞

正确答案：E。B细胞